直接舒张小动脉平滑肌的降压药是
A. 利舍平
B. 氢氯噻嗪
C. 硝苯地平
D. 肼屈嗪
E. 可乐定

正确答案：D。肼屈嗪